添加米汤、米糊、果泥等泥状食物应在
A. 10～12个月
B. 1～3个月
C. 4～6个月
D. 7～9个月
E. 12～15个月

正确答案：C。4～6个月

解析：4～6个月：泥状食物，如米汤、米糊、稀粥、蛋黄、鱼泥、菜泥、果泥。掌握“婴儿喂养方法”知识点。